《中华人民共和国执业医师法》第二十二条规定的医师的法律义务同时也是其基本的道德义务。这些义务应除外的是
A. 遵守法律、法规、技术操作规范
B. 树立敬业精神，遵守职业道德，履行医师职责，尽职尽责为患者服务
C. 维护医院形象，关心医院创收，积极推进公立医院盈利性、市场化改革
D. 关心、爱护、尊重患者，保护患者的隐私
E. 努力钻研业务，更新知识，提高专业技术水平

正确答案：C。维护医院形象，关心医院创收，积极推进公立医院盈利性、市场化改革

解析：医师的道德义务，就是在医疗活动中，医师在道德上对患者、他人及社会所负有的道德使命和道德责任。一般来说，法律义务都是道德义务，而道德义务不一定都是法律义务。根据《中华人民共和国执业医师法》规定，医师在执业活动中应履行下列义务：①遵守法律、法规，遵守技术操作规范；②树立敬业精神，遵守职业道德，履行医师职责，尽职尽责为患者服务；③关心、爱护、尊重患者，保护患者的隐私；④努力钻研业务，更新知识，提高专业技术水平；⑤宣传卫生保健知识，对患者进行健康教育。以上既是医师的法律义务，也是医德义务。此外，医师的道德义务还要求对患者尽义务与对他人、社会尽义务统一起来，并且把患者的权利也视为应尽的义务。掌握“医患关系伦理”知识点。